心包横窦位于
A. 心包腔前下部
B. 升主动脉和肺动脉干后方
C. 下腔静脉和心包后壁之间
D. 上腔静脉和右肺血管之间
E. 左心房后方

正确答案：B。升主动脉和肺动脉干后方

解析：升主动脉和肺动脉干后方（B对）与上腔静脉、左心房前壁前方之间的间隙有心包横窦。